人群对环境污染的暴露资料可以从以下途径获得，除了
A. 环境污染监测资料
B. 污染源综合评价资料
C. 生物监测资料
D. 个体监测资料
E. 专门的调查资料

正确答案：B。污染源综合评价资料

解析：本题考查人群对环境污染的暴露资料的获得途径。人群对环境污染的暴露资料可以从环境污染监测资料（A对）、生物监测资料（C对）、个体监测资料、专门的调查资料（E对）等途径获得。污染源综合评价资料（B错，为本题正确答案）不是人群对环境污染的暴露资料的获得途径。